慢性肾功能不全周围神经病变中较明显症状是
A. 弛缓性瘫痪
B. 震颤
C. 不宁腿综合征
D. 肌无力
E. 偏身瘫痪

正确答案：C。不宁腿综合征

解析：本题考查慢性肾功能不全周围神经病变。不宁腿综合症（C对）是一种临床上比较常见的疾病。本病的发病原因目前尚不清楚。常并发于胃部手术以后、尿毒症、酒精中毒、精神因素对发病具有一定重要性。